适于餐前服用的药品是
A. 莫沙必利
B. 艾司唑仑
C. 帕罗西汀
D. 氢氯噻嗪
E. 阿卡波糖

正确答案：A。莫沙必利

解析：本题考查药品服用的适宜时间。莫沙必利（A对）为促胃动力药，餐前服用能够帮助消化。艾司唑仑（B错）为催眠药，睡前服用。帕罗西汀（C错）为抗抑郁药，清晨服用。氢氯噻嗪（D错）最新版考试指导未说明。阿卡波糖（E错）为降糖药，适合餐中服用。